患者，女，60岁。平素经常头晕目眩，今日情绪激动后，突然半身不遂，神志昏迷，失语，小便失禁，舌红苔黄腻，脉弦数。应首先考虑的是
A. 中风中经络
B. 中风中脏腑
C. 脏躁
D. 癫痫肝火痰盛证
E. 癫痫肝风痰浊证

正确答案：B。中风中脏腑

解析：肝阳暴亢，阳升风动，气血上逆，夹痰火上蒙清窍，故平素经常头晕目眩，情绪激动后，突然半身不遂，神志昏迷，失语；风热痰火之邪内闭经络，故见小便失禁，诊断为中风中脏腑闭证（B对）。中风中经络（A错）表现为肌肤不仁，手足麻木，突然口眼歪斜，甚则半身不遂，不会出现神志昏迷。脏躁（C错）表现为精神恍惚，心神不宁，悲忧欠伸。癫痫（D错）（E错）表现为发作时昏仆抽搐，口吐涎沫。